新生儿经胎盘从母体接受了抗-HAV，所属的免疫种类为
A. 非特异性抵抗力
B. 人工主动免疫
C. 人工被动免疫
D. 自然主动免疫
E. 自然被动免疫

正确答案：E。自然被动免疫

解析：本题考查甲型肝炎的预防。按照获得方式的不同，保护易感人群特异性预防法可分为天然被动免疫（E对ABCD错）和人工被动免疫。前者是人或动物在天然情况下被动获得的免疫力。例如，母体内的抗体可经胎盘或乳汁传给胎儿，使胎儿获得一定的免疫力。